覆盖于膈的上面
A. 肺胸膜
B. 肋胸膜
C. 膈胸膜
D. 纵隔胸膜
E. 胸膜顶

正确答案：C。膈胸膜

解析：膈胸膜覆盖于膈的上面（C对）。